一般处方的用量不得超过
A. 当日
B. 三日
C. 五日
D. 七日
E. 十四日

正确答案：D。七日

解析：本题考查处方限量。一般处方的用量不得超过7日（D对）；急诊处方一般不得超过3日（B错）用量；对于某些慢性病、老年病或特殊情况，处方用量可适当延长，但医师必须注明理由。